肛管内腔面皮肤与粘膜的分界标志是
A. 肛直肠线
B. 肛梳
C. 齿状线
D. 痔环
E. 白线

正确答案：C。齿状线

解析：肛管内腔面皮肤与粘膜的分界标志是齿状线(C对)，也是区分内外痔的标志，白线(E错)是区分内外括约肌的标志。